关于畜禽肉类的营养价值叙述正确的是
A. 畜禽肉肌肉组织中蛋白质含量高于大豆
B. 畜肉的质地较禽肉细嫩且含氮浸出物多
C. 动物内脏含丰富的多不饱和脂肪酸
D. 畜禽内脏矿物质含量高于瘦肉
E. 畜禽肝脏营养价值高，特别富含维生素C和维生素B₂

正确答案：D。畜禽内脏矿物质含量高于瘦肉

解析：本题考查畜禽肉类的营养价值。畜禽肉矿物质含量为0.8%～1.2%，瘦肉中的含量高于肥肉，内脏高于瘦肉（D对）。畜禽肉蛋白质大部分存在于肌肉组织中，含量约为10%～20%，低于大豆（A错）。禽肉的质地较畜肉细嫩且含氮浸出物多（B错），故禽肉炖汤的味道较畜肉更鲜美。动物内脏以饱和脂肪酸为主（C错），含有较高的胆固醇。畜禽肉可提供多种维生素，其中以B族维生素和维生素A为主，尤其内脏含量较高，其中肝脏的维生素A和核黄素的含量特别丰富（E错）。